口腔扁平苔藓（OLP）上皮固有层内，有大量淋巴细胞呈密集带状浸润，与下列哪项因素有关
A. 心理因素
B. 内分泌因素
C. 微循环障碍因素
D. 免疫因素
E. 遗传

正确答案：D。免疫因素

解析：本题考查口腔扁平苔藓的病因。口腔扁平苔藓（OLP）上皮固有层内，有大量淋巴细胞呈密集带状浸润，与免疫因素（D对）有关。口腔扁平苔藓的病因：1.免疫因素：OLP上皮固有层内有大量T淋巴细胞呈密集带状浸润是其典型病理表现之一，表明OLP与T淋巴细胞介导的免疫反应有关。2.精神因素（A错）：研究表明，OLP的发生、发展与身心因素有密切关系。部分OLP患者有精神创伤史，或有因生活压力过大导致心情不畅、情绪焦虑等。临床中常见因这种心理异常导致患者机体功能紊乱，促使OLP发病、病情加重，或反复发作、迁延不愈。3.内分泌因素（B错）：流行病学调查发现，中年女性OLP发病率较高。一些女性OLP患者在妊娠期间病情缓解，哺乳期过后月经恢复时，病损复发。4.感染因素。5.微循环障碍因素（C错）：研究发现OLP患者的唇、舌黏膜、舌菌状乳头、眼球结膜等血管微循环改变，包括微血管扩张、血流的流速减慢。OLP患者的红细胞电泳时间、全血比黏度、还原黏度、红细胞聚集指数均增高。说明微循环障碍及高黏血症与OLP有关。6.遗传因素（E错）：曾在一个家庭中发现有数人发病；有些患者有家族史。有的学者发现OLP的HLA抗原的A3、B5、B8位点表达频度增高。近来国内有学者报告，0LP患者与HLA-DR1密切相关。有报道同卵双胞胎均出现表现相同的OLP，提示遗传倾向在0LP发病密切相关。7.其他：研究发现糖尿病、肝炎、高血压、消化道功能紊乱与OLP发病有关。也有报道锌、碘、镁等微量元素的异常可能与OLP发病有关。